阿司匹林抗血小板的作用机制是抑制
A. 血栓烷合成酶
B. 磷酸二酯酶
C. 环氧酶
D. 血小板腺苷环化酶
E. 凝血酶

正确答案：C。环氧酶

解析：本题考查抗血小板药的作用机制。阿司匹林抗血小板的作用机制是抑制环氧酶（C对），减少TXA₂生成，抑制TXA₂诱导的血小板聚集。奥扎格雷钠为血栓烷合成酶（A错）抑制剂。双嘧达莫为磷酸二酯酶（B错）抑制剂。前列环素为血小板腺苷环化酶（D错）刺激剂。凝血酶（E错）通过激活血小板，催化纤维蛋白原转化为纤维蛋白，促进血块稳定。